把医患关系归纳为主动-被动型、指导-合作型、共同参与型的是
A. 罗伯特-维奇
B. 布朗斯坦
C. 萨斯-荷伦德
D. 弗艾德
E. 迪肯

正确答案：C。萨斯-荷伦德

解析：美国学者萨斯-荷伦德根据医生与病人在医疗决策和执行中的地位、主动性将医患关系归纳为三种类型：主动-被动型、指导-合作型、共同参与型。掌握“医患沟通的理论、技术与其应用以及医患关系模式”知识点。